吸门指的是
A. 太仓下口
B. 会厌
C. 大小肠会
D. 齿
E. 唇

正确答案：B。会厌

解析：饮食物的消化吸收和排泄，须通过消化道的七道门户，《难经》称为“七冲门”。《难经·四十四难》：“唇为飞（扉）门（E错），齿为户门（D错），会厌为吸门（B对），胃为贲门，太仓下口为幽门（A错），大肠小肠会为阑门（C错），下极为魄门，故曰七冲门也。”